下列中药中外表棕褐至黑褐色，切面外侧棕褐色，木部黄白，有的可见放射状纹理的是
A. 葛根
B. 羌活
C. 白芷
D. 白蔹
E. 知母

正确答案：B。羌活

解析：本题考查的是羌活药材的性状鉴别。下列中药中外表棕褐至黑褐色，切面外侧棕褐色，木部黄白，有的可见放射状纹理的是羌活（B对）。羌活：【性状鉴别】药材根茎圆柱形，略弯曲。顶端具茎痕。表面棕褐色至黑褐色，外皮脱落处呈黄色。节间缩短，呈紧密隆起的环状，形似蚕，习称“蚕羌”；节间延长，形如竹节状，习称“竹节羌”。节上有多数点状或瘤状突起的根痕及棕色破碎鳞片。体轻，质脆，易折断，断面不平整，有多数裂隙，皮部黄棕色至暗棕色，油润，有棕色油点，木部黄白色，射线明显，髓部黄色至黄棕色。气香，味微苦而辛。葛根（A错）：【性状鉴别】药材呈纵切的长方形厚片或小方块。外皮淡棕色至棕色，有纵皱纹，粗糙。切面黄白色至淡黄棕色，有的纹理不明显。质韧，纤维性强。气微，味微甜。白芷（C错）：【性状鉴别】药材呈长圆锥形。顶端有凹陷的茎痕，根头部钝四棱形或近圆形；表面灰黄色至黄棕色，具纵皱纹、支根痕及皮孔样横向突起，习称“疙瘩丁”，散生或排列成四纵行。质坚实，断面白色或灰白色，粉性，形成层环棕色，近方形或近圆形，皮部散有多数棕色油点，气芳香，味辛、微苦。知母（E错）：【性状鉴别】药材毛知母呈长条状，微弯曲，略扁，偶有分枝，一端有浅黄色的茎叶残痕。表面黄棕色至棕色，上面有一凹沟，具紧密排列的环状节，节上密生黄棕色的残存叶基，由两侧向根茎上方生长；下面隆起略皱缩，并有凹陷或突起的点状根痕。质硬，易折断，断面黄白色。气微，味微甜、略苦，嚼之带黏性。白蔹（D错）的性状鉴别，2022年考试指南未明确说明。